某女，40岁。咳嗽、痰稠不易咳出，证属肺热，宜选用的药物是
A. 党参
B. 西洋参
C. 山药
D. 细辛
E. 瓜蒌

正确答案：E。瓜蒌

解析：本题考查的是瓜蒌的主治病证。咳嗽、痰稠不易咳出，证属肺热，宜选用的药物是瓜蒌（E对）。瓜蒌：【主治病证】（1）肺热咳嗽、痰稠不易咳出。（2）胸痹，结胸。（3）乳痈肿痛，肺痈，肠痈。（4）肠燥便秘。党参（A错）：【主治病证】（1）脾气亏虚之食欲不振、呕吐泄泻。（2）肺气亏虚之气短喘促、脉虚自汗。（3）气津两伤之气短口渴。（4）血虚萎黄，头晕心慌。西洋参（B错）：【主治病证】（1）阴虚热盛之咳嗽痰血。（2）热病气阴两伤之烦倦。（3）津液不足之口干舌燥，内热消渴。山药（C错）：【主治病证】（1）脾虚气弱之食少便溏或泄泻。（2）脾虚或肺肾两虚之喘咳。（3）肾阴虚证，消渴证。（4）肾虚遗精、尿频、带下。细辛（D错）：【主治病证】（1）风寒表证（尤宜鼻塞、头痛、肢体疼痛较甚者），阳虚外感。（2）鼻渊头痛。（3）头风头痛，牙痛，风寒湿痹痛。（4）寒饮咳喘。